使鞣质与钙离子结合生成水不溶物的除鞣质方法是
A. 冷热处理法
B. 石灰法
C. 铅盐法
D. 明胶法
E. 溶剂法

正确答案：B。石灰法

解析：本题考查的是除去鞣质的方法。使鞣质与钙离子结合生成水不溶物的除鞣质方法是石灰法（B对）。除去鞣质的方法：由于鞣质的性质不稳定，致使中药制剂易于变色、混浊或沉淀，从而影响制剂的质量，因此在很多中药中，鞣质被视为杂质。可采用以下方法除去中药提取物中的鞣质。1.冷热处理法（A错）：鞣质在水溶液中是一种胶体状态，高温可破坏胶体的稳定性，低温可使之沉淀。因此可先将药液蒸煮，然后冷冻放置，过滤，即可除去大部分鞣质。2.石灰法：利用鞣质与钙离子结合生成水不溶性沉淀，故可在中药的水提液中加入氢氧化钙，使鞣质沉淀析出；或在中药原料中拌入石灰乳，使鞣质与钙离子结合生成水不溶物，使之与其他成分分离。3.铅盐法（C错）：在中药的水提取液中加入饱和的乙酸铅或碱式乙酸铅溶液，可使鞣质沉淀而被除去，然后按常规方法除去滤液中过剩的铅盐。4.明胶法（D错）：在中药的水提取液中，加入适量4%明胶溶液，使鞣质沉淀完全，滤除沉淀，滤液减压浓缩至小体积，加入3～5倍量的乙醇，以沉淀过剩的明胶。5.聚酰胺吸附法：将中药的水提液通过聚酰胺柱，鞣质与聚酰胺以氢键结合而牢牢吸附在聚酰胺柱上，80%乙醇亦难以洗脱，而中药中其他成分大部分可被80%乙醇洗脱下来，从而达到除去鞣质的目的。6.溶剂法（E错）：利用鞣质与碱成盐后难溶于醇的性质，在乙醇溶液中用40%氢氧化钠调至pH9～10，可使鞣质沉淀，再过滤除去。